属于医学伦理学基本原则的是
A. 公正
B. 权利
C. 廉洁奉公
D. 医德评价
E. 医患关系

正确答案：A。公正

解析：目前对我国影响较大的美国生命伦理基本原则有“二原则说”、“四原则说”、“五原则说”等。其中生命伦理四原则经修改后逐渐成为我国教科书中的主要内容，即医学伦理学原则，分别为“尊重原则、不伤害原则、有利原则、公正（A对）原则”。